线粒体中丙酮酸彻底氧化发生
A. 3次脱羧，5次脱氢
B. 2次脱羧，5次脱氢
C. 4次脱羧，6次脱氢
D. 3次脱羧，7次脱氢
E. 4次脱羧，6次脱氢

正确答案：A。3次脱羧，5次脱氢